“启我爱医术，复爱世间人，愿绝名利心，尽力为病人，无分爱与憎，不问富与贫，凡诸疾病者，一视如同仁”出自的著作是
A. 《本草纲目》
B. 《省心录·论医》
C. 《迈蒙尼提斯祷文》
D. 《外科正宗》
E. 《备急千金要方》

正确答案：C。《迈蒙尼提斯祷文》

解析：“启我爱医术，复爱世间人，愿绝名利心，尽力为病人，无分爱与憎，不问富与贫，凡诸疾病者，一视如同仁”出自《迈蒙尼提斯祷文》（C对）。